根据《处方管理办法》，普通处方的印刷用纸颜色为
A. 淡黄色
B. 淡红色
C. 淡绿色
D. 淡蓝色
E. 白色

正确答案：E。白色

解析：本题考察处方管理。普通处方的印刷用纸颜色为白色（E对）。